下列关于静脉畸形的描述中，不正确的是
A. 好发于颊、颈、眼睑、唇、舌或口底部
B. 位置深浅不一
C. 表浅病损皮肤或黏膜颜色呈现蓝色或紫色
D. 边界清晰，扪之坚硬
E. 当头低位时；病损区则充血膨大

正确答案：D。边界清晰，扪之坚硬

解析：静脉畸形好发于颊、颈、眼睑、唇、舌或口底部。位置深浅不一，如果位置较深，则皮肤或黏膜颜色正常；表浅病损则呈现蓝色或紫色。边界不太清楚，扪之柔软，可以被压缩，有时可扪到静脉石。当头低位时；病损区则充血膨大；恢复正常位置后，肿胀亦随之缩小，恢复原状，此称为体位移动试验阳性。掌握“血管瘤与脉管畸形”知识点。